主要在胃、小肠吸收的药物，若在大肠也有一定吸收，则可考虑将制成的口服缓、控释制剂的服用间隔设计为
A. 6h
B. 12h
C. 24h
D. 36h
E. 48h

正确答案：C。24h

解析：本题考查缓释、控释制剂。缓、控释制剂应与普通制剂具有生物等效性，一般其生物利用度应在普通制剂的80%～120%范围内。若药物吸收部位主要在胃与小肠，宜设计成每12小时服用1次的制剂；若药物在结肠也有吸收，则考虑设计成每24小时（C对）服用1次的制剂。